医生于某医疗机构，参加抗菌药物合理使用培训并参加考核，合格后取得使用权，该医疗机构属于
A. 一级医院
B. 乡镇卫生院
C. 社区卫生服务中心
D. 二级医院
E. 村卫生室

正确答案：D。二级医院

解析：医生在当地二级以上的医院参加抗菌药物合理使用培训考核合格后，可取得使用权（D对）。一级医院、乡镇卫生院、区卫生服务中心、村卫生室等其他医疗机构依法享有处方权的医师、乡村医生和从事处于调剂工作的药师，由县级以上地方卫生行政部门组织相关培训、考核。经考核合格的，授予相应的抗菌药物处方权或者抗菌药物调剂资格（ABCE错）。